患部形小而圆，红肿热痛不甚的疮疡病变是
A. 痈
B. 疔
C. 疖
D. 疮
E. 疽

正确答案：C。疖

解析：患部形小而圆，红肿热痛不甚符合疖的临床表现（C对），其因外感火热毒邪或 湿热蕴结所致。痈是指患部红肿高大，根盘紧束，锨热疼痛，并能形成脓疡的疾病(A错)。疔的患部形小如粟，根深如钉，漫肿灼热，麻木疼痛（B错）。疮是各种致病因素侵袭人体后引起的体表化脓性疾病，包括了痈、疔、疮等（D错）。疽则患部漫肿无头，皮色不变（E错）。